男，32岁。2日来右下后牙痛，不能咬物。半年前发现右下后牙龈有小包，平时无明显不适。检查见右上6远中面龋坏深，左上1龋深，穿髓孔探无感觉，叩诊（±），右下8和右下7间根尖处牙龈有瘘管开口，压挤少许脓液处。右下8前倾阻生，龈红肿明显，探龈袋深部有脓液。X片见右上6远中根尖周X线透射区不规则，边界模糊。引起主诉症状的患牙诊断是急性智齿冠周炎，为确诊牙龈瘘管的病源牙，应作
A. 瘘管探诊
B. 牙周袋探诊
C. X线片检查
D. 瘘管诊断丝X线片
E. 牙周袋诊断丝X线片

正确答案：D。瘘管诊断丝X线片

解析：本题考查窦型慢性根尖周炎的检查。通过对瘘管作瘘管诊断丝X线片（D对）检查可以在X片上显示诊断丝在窦道中的走行，从而以确定窦道的来源，避免将窦道附近的健康牙误诊为患牙。瘘管探诊（A错）即将探针插入瘘管探查，可以了解瘘管的深度、方向，是否贯通，但不能显示探针的走形，故不能了解其来源。牙周袋探诊（B错）多用于确定牙周袋深度以及牙周状况。X线片检查（C错）时，软组织和瘘管不容易区分，不能从X线上确定瘘管来源。牙周袋诊断丝X线片（E错）这种检查方法并不存在。